符合右心房肥大心电图特点的是
A. P波时间=0.15s
B. P波时间=0.10s
C. Ⅰ导联P波振幅=0.1mV
D. aVL导联P波振幅=0.22mV
E. Ⅱ导联P波振幅=0.3mV

正确答案：E。Ⅱ导联P波振幅=0.3mV

解析：右心房肥大的心电图特点是：①P波电压增高∶在肢体导联Ⅱ、Ⅲ、aVF上P波电压≥0.25mV（E对D错）；P波时限≥0.12s，见于左心房肥大（AB错）。在胸前导联V₁、V₂上P波电压≥0.15mV（C错），或IPI>0.03mm·s。②P波形态高尖，在下壁导联尤为突出。③P波电轴右偏，+75°～+90°。④在QRS波群低电压的情况下，P波尖峰且振幅大于同导联R波的1/2即可诊断（E对）。